男，40岁。半年来左上后牙遇冷热痛，但无自发痛，近1月来，除冷热过敏外隐隐作痛。近1周出现自发痛，阵发加剧，夜间痛。检查发现左上第二磨牙近中（牙合）面龋深穿髓，探痛明显，叩痛（±）。主诉牙最有可能的诊断是
A. 深龋
B. 急性牙髓炎
C. 牙龈乳头炎
D. 慢性牙龈炎
E. 急性根尖炎

正确答案：B。急性牙髓炎

解析：本题考查急性牙髓炎的临床表现。根据病例描述，左上后牙有自发痛，阵发加剧，夜间痛，左上7近中（牙合）面龋深穿髓，探痛明显，叩痛（±），可以怀疑为深龋引起的牙髓的急性炎症，故最有可能的诊断是急性牙髓炎（B对）。深龋（A错）不会有自发痛。牙龈乳头炎（C错）也可出现剧烈的自发性牙痛，但疼痛性质为持续性胀痛，刺激也会有敏感反应，但一般不会出现激发痛，并且检查时可发现龈乳头充血、水肿，触痛明显，病例中疼痛为阵发加剧，夜间痛，也未描述牙龈的状况，故不考虑为牙龈乳头炎。慢性牙龈炎（D错）为牙龈的色形质改变，不会出现疼痛。急性根尖炎（E错）为持续性痛，咬合痛，且叩痛明显。